肾病综合征的临床特征是
A. 大量蛋白尿，低白蛋白血症，高胆固醇血症，明显浮肿
B. 血尿，低白蛋白血症
C. 血尿，水肿，高血压，程度不等的肾功能损害
D. 高血压，大量蛋白尿
E. 高血压，低白蛋白血症

正确答案：A。大量蛋白尿，低白蛋白血症，高胆固醇血症，明显浮肿

解析：肾病综合征的的诊断时大量蛋白尿，尿蛋白（+++～++++），24小时尿蛋白定量≥ 50mg/kg；血浆白蛋白低于25g/L；血浆胆固醇高于 5.7mmol/L； 不同程度的水肿。以上四项中以大量蛋白尿和低白蛋白血症为必要条件（A对）。急性肾炎以血尿为主，伴不同程度的蛋白尿、水肿、高血压或肾功能不全为特点（BCDE错）。